患者，男，54岁，因出现午后低热、乏力、盗汗就诊，诊断为肺结核，给予抗结核治疗，要是对患者的用药指导，正确的有
A. 症状缓解后即可停药
B. 应规律、全程用药
C. 限制高蛋白和维生素的摄入
D. 注意消毒与隔离
E. 告知用药注意事项及不良反应

正确答案：B、D、E。应规律、全程用药；注意消毒与隔离；告知用药注意事项及不良反应

解析：本题考查结核药的用药指导。结核药的治疗必须遵循“早期、联合、适量、规律和全程”的原则（B对）。结核菌侵入人体后具有滞留性、潜伏性、冬眠性及突变性等特点，使结核病在病程上易迁延不愈，往往需要较长程的联合化疗，否则易于复发，甚至发展为耐药结核病、耐多药结核病，乃至称为难治结核病（A错）。增加高蛋白和维生素的摄入，日光浴可以调理患者的体质（C错）。肺结核具有传染性，患者需要隔离，其所接触的环境和物品需要消毒处理，或者焚烧（D对）。需充分了解抗结核药物服用中可能出现的不良反应，一旦出现要及时报告医生（E对）。